下列病毒中可以引起潜伏感染的是
A. 麻疹病毒
B. 疱疹病毒
C. 风疹病毒
D. 乙型肝炎病毒
E. 乙型脑炎病毒

正确答案：B。疱疹病毒

解析：疱疹病毒潜伏于神经节内，人体受到非特异性刺激后，潜伏的病毒被激活转化为增殖性感染。掌握“疱疹病毒”知识点。